为全面了解河流的污染状况，应在不同区域设置不同的采样断面，包括
A. 清洁断面、污染断面、对照断面
B. 自净断面、清洁断面、污染断面
C. 对照断面、自净断面、污染断面
D. 清洁断面（或对照断面）、污染断面、自净断面
E. 污染断面、自净断面、污染断面

正确答案：D。清洁断面（或对照断面）、污染断面、自净断面

解析：本题考查采样断面的设置。为全面了解河流的污染状况，应在不同区域设置不同的采样断面，包括：①设在污染源的上游清洁或对照断面，可了解河水未受本地区污染时的水质状况；②设在污染源的下游的污染断面，可了解水质污染状况和程度；③设在污染断面下游一定距离的自净断面（D对ABCE错），可了解污染范围及河水的自净能力。